过量使用，会导致大量的中间代谢产物N-乙酰对苯醌亚胺堆积，引起严重肝毒性的药物是
A. 双氯芬酸
B. 对乙酰氨基酚
C. 塞来昔布
D. 阿司匹林
E. 尼美舒利

正确答案：B。对乙酰氨基酚

解析：本题考查药物的用法用量。对乙酰氨基酚（B对）过量使用会导致大量的中间代谢产物N-乙酰对苯醌亚胺堆积，引起严重肝毒性；双氯芬酸（A错）属于芳基乙酸类非甾体抗炎药，用于各种急慢性关节炎软组织风湿所致的头疼，以及创伤后、术后的疼痛等；阿司匹林（D错）为环氧酶抑制剂，用于不稳定型心绞痛、急性心肌梗死等脑血管疾病；塞来昔布（C错）属于选择性COX-2抑制剂，用于缓解骨性关节炎、类风湿性关节炎、强制性脊柱炎的肿痛症状；尼美舒利（E错）是一种选择性COX-2抑制剂，用于慢性关节炎。